病例对照研究中反映暴露与疾病关联强度的指标是
A. 比值比
B. 卡方值
C. 人年发病率
D. 患病率
E. 相对危险度

正确答案：A。比值比

解析：本题考查病例对照研究中反映暴露与疾病关联强度的指标。比值比（A对BCDE错）为病例组与对照组两组暴露比值之比，表示暴露者疾病的危险性是非暴露者的多少倍。是反映暴露与疾病关联强度的指标。